引起牙周生态系平衡失调的可能原因是
A. 局部因素如牙石、（牙合）创伤等可增强细菌的堆积和侵袭力
B. 全身因素如吸烟、内分泌失调等可降低宿主的防御力和修复力
C. 免疫缺陷、营养不良可加重牙周组织的炎症反应和破坏作用
D. 正常菌群间或牙周菌群与宿主之间失去相互制约和平衡
E. 以上均是

正确答案：E。以上均是

解析：本题考查引起牙周生态系平衡失调的原因。牙周微生物可受口腔相关生态区微生物的影响，牙周菌群之间以及他们与宿主之间的相互作用称为牙周生态系。口腔微生物以及宿主体内、外因素均可影响牙周生态系，口腔微生物和宿主之间既可维持生态平衡，也可发生生态失调。当正常菌群间或牙周菌群与宿主之间失去相互制约和平衡（D对），便可引起牙周生态系平衡失调，引发牙周病。牙周感染能否成立，实际上由细菌、宿主和环境三方面决定，影响动态平衡的一些局部因素如牙石、（牙合）创伤等可增强细菌的堆积和侵袭力（A对），一些全身因素如吸烟、内分泌失调等可降低宿主的防御力和修复力（B对），免疫缺陷、营养不良可加重牙周组织的炎症反应和破坏作用（C对）。（ABCD均对，故E为本题的正确答案）。